输血引起的急性溶血的特异性表现
A. 尿呈深黄色，尿胆原阳性
B. 尿呈酱油色，尿胆原阳性
C. 尿呈深黄色，尿胆原阴性
D. 尿呈酱油色，尿胆原阴性
E. 外周血网织红细胞增高并出现幼稚红细胞

正确答案：D。尿呈酱油色，尿胆原阴性

解析：输血后发生急性溶血反应时，大量红细胞被破坏，机体不能及时分解的血红蛋白进入尿液出现血红蛋白尿，呈浓茶色或酱油色。而被分解的血红蛋白形成大量的非结合胆红素，超过肝细胞的摄取、结合和排泌能力，血中非结合胆红素蓄积超过正常水平而出现溶血性黄疸。尿胆原短时间不能呈阳性。综上，输血引起的急性溶血的特异性表现为尿呈酱油色，尿胆原阴性（D对ABC错）。输血引起的急性溶血是急性的红细胞破坏，骨髓来不及代偿，故外周血网织红细胞和幼稚红细胞不会增加（E错）。